男，35岁。右上第一磨牙牙髓治疗后劈裂，拔牙过程中牙冠碎裂至龈下，牙根与周围骨质粘连。此时拔除此根应先
A. 牙挺取根
B. 牙钳拔除
C. 分根后拔除
D. 翻瓣去骨拔除
E. 涡轮钻拔除

正确答案：C。分根后拔除

解析：本题考查牙根拔除术。由于患者牙根与周围骨质粘连，增大了根部骨阻力，且牙冠碎裂，所以可以分根后拔除牙根（C对）。患牙根与牙骨质粘连，增大了根部骨阻力，直接牙挺拔牙（A错）很难把牙根拔出，需要分根、去骨、增隙。对于高位的残根、断根可用牙钳直接拔除（B错）。翻瓣去骨拔除法（D错）对组织创伤大，且去除牙槽突会使牙槽突变窄、变低，不利于义齿修复，故应慎用，与题干不符。高速涡轮机（E错）的冷却水传输管道消毒困难，无法达到无菌要求，对组织不良反应大，术后渗出多，易致骨灼伤，易导致皮下气肿，故一般不采用。